男，64岁。胆结石术后5天突发呼吸困难1小时，有COPD史20余年。查体：110/80mmHg，端坐呼吸，烦躁不安，大汗口唇发绀，双肺可闻及少量干湿啰音，心率120次/分。该患者呼吸困难最可能的原因是并发
A. 急性呼吸窘综合征
B. 急性左心衰竭
C. 继发肺部感染
D. 自发性气胸
E. 右心衰竭

正确答案：A。急性呼吸窘综合征

解析：患者为老年男性，有胆结石手术史（是急性呼吸窘迫综合征的常见危险因素），突然发生呼吸困难，端坐呼吸，烦躁不安，大汗，口唇发绀，双肺可闻及少量干湿啰音，心率120次/分，考虑诊断为急性呼吸窘迫综合症（A对）。急性左心衰（P174-P175）（B错）常表现为突发性呼吸困难，端坐位，咳粉红色泡沫痰，听诊时两肺布满湿性啰音和哮鸣音。肺部感染性疾病（P42）（C错）主要表现为发热、咳嗽、咳痰、双侧肺叩诊浊音、语颤增强，很少有突然发生的呼吸困难。自发性气胸（P120）（D错）大多起病急骤，患者突感一侧胸痛，针刺样或刀割样，持续时间短，继之胸闷和呼吸困难。右心衰竭（P167）（E错）主要以体循环淤血为主要变现，如恶心呕吐等消化道症状、劳力性呼吸困难、水肿、肝脾肿大、颈静脉征阳性等。